成人I型当FiO2不足20％时呼吸衰竭的诊断标准是:
A. PaO2＜8.0kPa(1kPa=7.5mmHg)
B. PaO2＞6.67kPa
C. PaO2＜9.3kPa
D. RFI(呼吸衰竭指数)≤300
E. PaO2＜8.0kPa伴有PaCO2＞6.67kPa

正确答案：D。RFI(呼吸衰竭指数)≤300

解析：成人I型当FiO2不足20％时呼吸衰竭的诊断标准是RFI(呼吸衰竭指数)≤300